女，26岁，上1缺失，其余牙覆（牙合）覆盖正常，应该做的处理是
A. 不做处理
B. 金属固定桥修复
C. 局部可摘义齿修复
D. 全瓷固定桥修复

正确答案：D。全瓷固定桥修复

解析：本题考查固定桥修复。患者女，26岁，上1缺失，其余牙覆（牙合）覆盖正常，应该做的处理是全瓷固定桥修复（D对）。不做处理（A错）、待回忆（E错）均不符合牙列缺损的修复原则。题干中患者为年轻女性，且缺失牙齿为上前牙，因此金属固定桥修复（B错）直接影响患者美观；局部可摘义齿修复（C错）的舒适度不如固定修复，因此不采用。